麦味地黄丸的功能是
A. 滋阴养血
B. 滋肾养肝
C. 滋肾养肺
D. 滋阴降火
E. 滋阴益阳

正确答案：C。滋肾养肺

解析：本题考查的是麦味地黄丸的功能。麦味地黄丸的功能是滋肾养肺（C对）。麦味地黄丸：【功能】滋肾养肺。养血安神丸：【功能】滋阴养血（A错），宁心安神。杞菊地黄丸：【功能】滋肾养肝（B错）。知柏地黄丸：【功能】滋阴降火（D错）。功能为滋阴益阳（E错）的中成药，2022年考试指南未明确说明。